正常小儿前囟闭合最晚的年龄是
A. 10个月
B. 2岁
C. 1岁8个月
D. 2岁半
E. 3岁

正确答案：B。2岁

解析：前囟出生时约1～2cm，以后随颅骨生长而增大，6月龄左右逐渐骨化而变小，最迟于2岁闭合，故正常小儿前囟闭合最晚的年龄是2岁（B对）。